妊娠32周的重度子痫前期孕妇，恰当的处理应是
A. 积极治疗，等待产程发动
B. 积极治疗24～48小时，症状无明显改善时应终止妊娠
C. 积极治疗一周后，予以引产
D. 立即引产
E. 立即行剖宫术

正确答案：B。积极治疗24～48小时，症状无明显改善时应终止妊娠

解析：重度子痫前期患者：妊娠＜26周经治疗病情不稳定者建议终止妊娠；妊娠26～28周根据母胎情况及当地母儿诊治能力决定是否期待治疗；妊娠28～34周，如病情不稳定，经积极治疗24～48小时病情仍加重，促胎肺成熟后终止妊娠；如病情稳定，可考虑期待治疗，并建议转至具备早产儿救治能力的医疗机构；妊娠≥34周患者，胎儿成熟后可考虑终止妊娠；妊娠37周后的重度子痫前期应终止妊娠。掌握“娠期高血压疾病”知识点。